属于低效消毒剂的是
A. 紫外线
B. 碘伏
C. 碘酊
D. 酚类
E. 氯己定

正确答案：E。氯己定

解析：本题考查消毒方法的分类。属于低效消毒剂的是氯己定（E对）。紫外线为高效消毒方法（A错）。碘类消毒剂，如碘伏（B错）、碘酊（C错）和酚类（D错）消毒剂为中效消毒方法。